男，46岁，腹痛2年，加重2周，其余生命体征正常，有压痛，反跳痛，肌紧张，肝脏检查阴性。余均正常。相关病史为
A. 吸烟
B. 幽门螺杆菌感染
C. 饮酒
D. 感染
E. 发热

正确答案：B。幽门螺杆菌感染

解析：幽门螺杆菌感染是消化性溃疡的重要致病因素（B对）。大量饮酒、长期吸烟、应激等是消化性溃疡的常见诱因（AC错）。感染，发热不是消化性溃疡的病因（DE错）。